驱虫药服用时间是
A. 饭前服
B. 空腹服
C. 饭后服
D. 定时服
E. 睡前服

正确答案：B。空腹服

解析：驱虫药一般应在空腹时服用，使药物能充分作用于虫体而保证疗效（B对）。饭前服（A错）多是补虚药或治疗胃肠疾病的药物。饭后服（C错）多是消食健胃药或对胃肠有刺激的药物。截疟药（D错）多定时服。睡前服（E错）多为安神药、涩精止遗药。